可同时了解肾积水患者的肾功能及其梗阻程度的检查方法是
A. 逆行肾盂造影
B. MRI
C. CT
D. B超
E. 放射性核素肾图

正确答案：E。放射性核素肾图

解析：可同时了解肾积水患者的肾功能及其梗阻程度的检查方法是放射性核素肾图（E对）。逆行肾盂造影（A错）、CT（C错）、B超（D错）主要用于明确梗阻部位及肾积水情况。MRI（B错）水成像虽对梗阻定位有极大帮助，但其价格昂贵，成像时间长等因素限制了临床应用。